患者，男，25岁，因淋雨后高热寒战，今日高热骤降，大汗肢冷，胸痛不止，咳嗽气急，咯铁锈色痰，唇甲青紫，神志恍惚，舌红少津，脉微细欲绝。应首先考虑的是
A. 干性胸膜炎
B. 休克型肺炎
C. 心绞痛
D. 胃溃疡穿孔
E. 急性心肌梗死

正确答案：B。休克型肺炎

解析：从高热寒战，咳嗽气急，咯铁锈色痰可判断为肺炎；从高热骤降，大汗肢冷，唇甲青紫，神志恍惚，舌红少津，脉微细欲绝可判断为休克表现，综合判断为休克型肺炎（B对）。干性胸膜炎（A错）主要表现为持续性胸痛，与呼吸有关。心绞痛（C错）表现为发作性胸闷、发憋。胃溃疡穿孔（D错）表现为突然持续性剧烈腹痛。急性心肌梗死（E错）多表现为持续性剧烈胸痛、胸闷。